非处方药绿色专有标识图案用于
A. 甲类非处方药
B. 乙类非处方药
C. 在药品分类管理中目前实行双轨制的药品
D. 药品生产企业使用的指南性标志
E. 刊登药品广告时使用的指南性标志

正确答案：B。乙类非处方药

解析：本题考查非处方药专有标识。非处方药专有标识图案分为红色和绿色，绿色专有标识用于乙类非处方药品（B对）和用作指南性标志，红色专有标识用于甲类非处方药品（A错）。